对蛋白质变性的描述正确的是
A. 变性蛋白质的溶液黏度下降
B. 变性的蛋白质不易被消化
C. 蛋白质沉淀不一定就是变性
D. 蛋白质变性后容易形成结晶
E. 蛋白质变性不涉及二硫键破坏

正确答案：C。蛋白质沉淀不一定就是变性

解析：蛋白质沉淀还有可能是和重金属离子结合